经产妇，27岁，32周妊娠，昨日夜晚突然出现无痛性阴道流血，最可能的诊断是
A. 前置胎盘
B. 羊水过多
C. 胎盘早剥
D. 先兆子宫破裂
E. 子宫破裂

正确答案：A。前置胎盘

解析：青年经产妇，32周妊娠（28周及以后为妊娠晚期），突然出现无痛性阴道流血，（前置胎盘的典型症状为妊娠晚期或临产时，发生无诱因、无痛性反复阴道流血），最可能的诊断是前置胎盘（A对）。羊水过多（P136）（B错）多发生在20～24周，表现为一系列压迫症状，如行动不便，因横隔抬高，出现呼吸困难，甚至发绀，不能平卧等。胎盘早剥（P131）（C错）多见于有重度妊娠高血压综合征等病因，突然出现阴道流血伴下腹痛。先兆子宫破裂（P218）（D错）多发生在分娩期，常见于产程长、有梗阻性难产因素的产妇，表现为子产妇烦躁不安，呼吸、心率加快，下腹剧痛难忍，出现少量阴道流血。